我国引起肝硬化最常见的原因是
A. 酒精中毒
B. 营养障碍
C. 病毒性肝炎
D. 胆汁淤积
E. 循环障碍

正确答案：C。病毒性肝炎

解析：引起肝硬化的病因很多，目前我国引起肝硬化的病因以病毒性肝炎（乙型病毒性肝炎）为主。掌握“肝硬化”知识点。